在休克早期临床表现中哪项是错误的：
A. 面色苍白
B. 四肢湿冷
C. 尿量减少
D. 脉压增大
E. 脉搏细速

正确答案：D。脉压增大

解析：在休克早期患者表现为脸色苍白（A对），四肢湿冷（B对），出冷汗，脉搏加快（E对），脉压减小（D错，为本题正确答案），尿量减少（C对），烦躁不安。由于血液的重新分配，心、脑灌流量此时仍可维持正常。因此，患者在休克代偿期间神志一般是清楚的，但常显得烦躁不安（图13-4)。该期患者血压可骤降（如大失血），也可略降，甚至因代偿作用可正常或轻度升高，但是脉压会明显缩小，患者脏器有效灌流量明显减少。